子宫肌瘤的症状与下列何项关系密切
A. 肌瘤的大小
B. 肌瘤生长部位（宫体，宫颈）
C. 发生年龄
D. 肌瘤与肌层的关系（黏膜下，浆膜下，壁间）
E. 肌瘤数目

正确答案：D。肌瘤与肌层的关系（黏膜下，浆膜下，壁间）

解析：子宫肌瘤患者多无明显临床症状，与症状轻重关系最密切的是肌瘤的生长部位（B错），但与大小（A对）和有无变性也相关、而与肌瘤数目（E错）、发生年龄（C错）关系不大。很小的黏膜下肌瘤可以引起经量增多和经期延长，很大的浆膜下肌瘤不一定能引起经量增多和经期延长，因此肌瘤与肌层关系（ D对）与临床症状轻重关系最密切。